心气虚证常见
A. 心悸气短，体倦乏力
B. 心悸胸闷，形寒肢冷
C. 心悸心烦，唇舌色淡
D. 心悸心烦，潮热盗汗
E. 心悸胸闷，心前区刺痛

正确答案：A。心悸气短，体倦乏力

解析：本题考查的是心病主要证候的临床表现及辨证要点。心气虚证常见心悸气短，体倦乏力（A对）。心病主要证候有心气虚证、心阳虚证、心血虚证、心阴虚证、心血瘀阻证及心火亢盛证。1.心气虚证与心阳虚证的临床表现及辨证要点：心阳虚与心气虚的共有症状是：心悸，气短，自汗，活动或劳累后加重。心气虚证的临床表现，除上述共有症状外，兼见面色白、体倦乏力、舌质淡、舌体胖嫩、苔白、脉虚。心阳虚证的临床表现，除上述共有症状外，兼见形寒肢冷（B错）、心胸憋闷、面色苍白、舌淡或紫暗脉细弱或结代。如出现心阳虚脱，除有心阳虚的症状外，兼见大汗淋漓、四肢厥冷、口唇青紫、呼吸微弱、脉微欲绝。心气虚证与心阳虚证的辨证要点：心气虚与心阳虚往往由于年老脏气日衰，或由其他疾病的转变，或者由于汗、下太过以及各种损伤气血的原因而形成。心气虚证以心本脏及全身功能活动衰弱为辨证要点。心阳虚证以在心气虚证的基础上出现虚寒症状为辨证要点。2.心血虚证与心阴虚证的临床表现及辨证要点：心血虚与心阴虚的共同症状是：心悸，心烦，易惊，失眠，健忘。心血虚证的临床表现，除上述症状外，兼见眩晕、面色不华、唇舌色淡（C错）、脉细弱。心阴虚证的临床表现，除上述症状外，兼见低热、盗汗（D错）、五心烦热、口干、舌红少津、脉细数。心血虚证与心阴虚证的辨证要点：心血虚与心阴虚，或由于血的生化之源不足，或继发于失血之后，如产后失血过多、崩漏、外伤出血等，亦可由过度劳神，致营血亏虚、阴精暗耗所引起。心血虚证以心的常见症状与血虚证共见为辨证要点。心阴虚证以心的常见症状与阴虚证共见为辨证要点。3.心血瘀阻证与心火亢盛证的临床表现及辨证要点：心血瘀阻证的临床表现，多见心悸，心前区刺痛（E错）或闷痛，并常引臂内侧疼痛，尤以左臂痛厥为多见，一般痛势较剧，时作时止，重者并有面、唇、指甲青紫，四肢逆冷，舌质暗红，或见紫色斑点，苔少，脉微细或涩。一般以胸部憋闷疼痛、痛引肩背内臂、时发时止为辨证要点。心火亢盛证的临床表现，多见心中烦热，急躁失眠，口舌糜烂疼痛，口渴，舌红，脉数，甚则发生吐血、衄血。心火亢盛证以心及舌、脉等有关组织出现实火内炽的症状为辨证要点。